化学毒物与机体毒作用的剂量-反应（效应）关系最常见的曲线形式是
A. 直线型曲线
B. 抛物线型曲线
C. 对称S状曲线
D. 非对称S状曲线

正确答案：D。非对称S状曲线

解析：本题考查化学毒物与机体毒作用的剂量-反应（效应）关系最常见的曲线形式。化学毒物与机体毒作用的剂量-反应（效应）关系最常见的曲线形式是非对称S状曲线（D对ABC错）。非对称S形曲线两端不对称，一端较长，另一端较短。